糖皮质激素隔日清晨一次适量给药的临床适应症是
A. 肾病综合征
B. 鹅口疮
C. 中毒性菌痢
D. 过敏性休克
E. 肾上腺皮质次全切术后

正确答案：A。肾病综合征

解析：用糖皮质激素治疗肾病综合征时选用一般剂量长期疗法。因糖皮质激素的分泌具有昼夜节律性，上午8～10时分泌最多，随后逐渐下降，午夜12时分泌最少，这是由ACTH昼夜节律所致。临床用药可配合这种生理的节律性，所以在一般剂量长期疗法中，对某些慢性病采用隔日一次给药法，即将2日的总量隔日上午7～8时一次服完。此时正值皮质激素正常分泌的高峰，对肾上腺皮质功能的负反馈抑制最小，可减轻药物的不良反应（A对）。